含有交感神经的节后纤维
A. 内脏大神经
B. 内脏小神经
C. 腰内脏神经
D. 颈上、中、下心神经
E. 盆内脏神经

正确答案：D。颈上、中、下心神经

解析：内脏大神经（A错）由穿过第5或第6-9胸交感干神经节的节前纤维组成。内脏小神经（B错）,由穿过第10-12胸交感干神经节的节前纤维组成。腰内脏神经（C错）由穿过腰神经节的节前纤维组成。颈上、中、下心神经（D对）由颈部交感干神经节发出节后纤维组成。盆内脏神经（E错）由节前纤维组成。